鉴别黄体酮的依据是
A. 酸性溶液中析出白色沉淀
B. 与氯化三苯四氮唑试液反应显红色
C. 与三氯化铁试液反应呈草绿色
D. 与亚硝基铁氰化钠反应显蓝紫色
E. 与亚硒酸反应呈绿色，渐变蓝色

正确答案：D。与亚硝基铁氰化钠反应显蓝紫色

解析：本题考查黄体酮的鉴别。黄体酮与亚硝基铁氰化钠的反应是黄体酮专属、灵敏的鉴别方法，黄体酮显蓝紫色（D对），而其他甾体激素类药物均不显蓝紫色。